脾之大络，名为
A. 天池
B. 俞府
C. 鸠尾
D. 大包
E. 虚里

正确答案：D。大包

解析：脾的大络，名曰大包，在渊腋穴下3寸处发出，散布于胸胁部。它的病变，实证为一身尽痛，虚证为周身肌肉关节松弛无力（D对）。鸠尾—任脉之络（C错）。天池为手厥阴心包经经穴（A错）。